偏食辛温燥热饮食，则可致
A. 心肝火旺
B. 肺胃热盛
C. 肺胃津伤
D. 肝经湿热
E. 肠胃积热

正确答案：E。肠胃积热

解析：偏食辛温燥热饮食，会使肠胃当中积热，主要伤及的脏腑为脾胃（E对）。心肝火旺可因心情导致，而非饮食（A错）。一般涉及肺，主要原因为外感，因为肺为娇脏，易感受外邪而致病，而非偏食辛温燥热食物（BC错）。